小儿积滞脾虚夹积证的首选药物是
A. 酵母片
B. 乳酸菌素片
C. 健脾丸
D. 乳酶生
E. 肥儿丸

正确答案：C。健脾丸

解析：积滞脾虚夹积证多由乳食内积证日久不愈转化而来，治以健脾助运，消食化积，方药为健脾丸（C对）。酵母片（A错）临床上常用于治疗消化不良。乳酸菌素片（B错）临床上常用于肠内异常发酵、消化不良、肠炎和小儿腹泻。乳酶生（D错）临床上常用于消化不良，肠内异常发酵，小儿腹泻及小儿绿便等。肥儿丸（E错）其功用为消积理脾。适用于疳积证。